关于阴道,不正确的是
A. 为前后扁、呈塌陷状态，且富有伸展性的肌性管道,
B. 上部宽大而下部窄，前壁短而后壁较长
C. 前方邻接膀胱体和膀胱颈
D. 开口位于尿道的前上方
E. 阴道后穹邻直肠子宫陷凹，为临床常用的穿刺部位

正确答案：D。开口位于尿道的前上方

解析：阴道是性交器官，也是月经排出和胎儿挽出的管道，前后壁常处于相贴状态为前后扁、呈塌陷状态，且富有伸展性的肌性管道（A对），上部宽大而下部窄，前壁短而后壁较长（B对），前方邻接膀胱体和膀胱颈（C对），开口位于尿道的下方（D错为本题正确答案），阴道后穹邻直肠子宫陷凹，为临床常用的穿刺部位（E对）。